银杏中主要成分的类型是
A. 简单香豆素
B. 呋喃香豆素
C. 新木脂素
D. 黄酮苷
E. 简单木脂素

正确答案：D。黄酮苷